以下哪项疾病没有剥脱性龈病损的特征
A. 类天疱疮
B. 天疱疮
C. 白斑
D. 扁平苔藓
E. 红斑狼疮

正确答案：C。白斑

解析：本题考查牙龈疾病。白斑（C错，为本题正确答案）没有剥脱性龈病损的特征。所谓的剥脱性龈炎不是或大多数不是一种独立的疾病，而是许多疾病在牙龈上的表征，其中包括类天疱疮（A对）、扁平苔藓（C对）、天疱疮（B对）、红斑狼疮（E对）等。